男，72岁，脑血管病患者。住院期间突然半夜起床活动。无目的地摸床，摸墙，摸病友的头，自语，白天安静入睡。该患者治疗不宜选用的药物是
A. 胆碱酯酶抑制剂
B. 氟哌啶醇
C. 苯二氮类镇静催眠药
D. 阿司匹林
E. 丙戊酸钠

正确答案：E。丙戊酸钠

解析：患者为老年男性，有脑血管病史，突发精神神智异常症状，考虑诊断为血管性痴呆。血管性老年痴呆如能早期治疗，预后相对较好，其治疗包括运用阿司匹林（D对）等抗血小板聚集的病因治疗，运用胆碱酯酶抑制剂（A对）等对认知症状的治疗和运用氟哌啶醇（B对）等抗精神病药物、苯二氮类镇静催眠药（C对）等对症治疗。丙戊酸钠（E错，为本题正确答案）是一种广谱抗癫痫药物，对血管性痴呆治疗无效。